槐花性微寒，除能凉血止血外，还能
A. 清热安胎
B. 祛瘀，通经
C. 解毒，截疟
D. 祛痰止咳
E. 清肝泻火

正确答案：E。清肝泻火

解析：本题考查的是槐花的功效。槐花性微寒，除能凉血止血外，还能清肝泻火（E对）。槐花：【功效】凉血止血，清肝泻火。苎麻根：【功效】凉血止血，清热安胎（A错），利尿，解毒。茜草：【功效】凉血，祛瘀，止血，通经（B错）。仙鹤草：【功效】收敛止血，止痢，截疟，解毒（C错），杀虫，补虚。侧柏叶：【功效】凉血止血，祛痰止咳（D错），生发乌发。